某医生收集到数据经过统计学家分析应该进行t检验。进行t检验的资料应满足的条件是
A. 负偏态资料
B. 正偏态资料
C. 偏态资料
D. 正态或近似正态资料
E. 以上都不是

正确答案：D。正态或近似正态资料

解析：t检验常用于样本例数较小、总体标准差未知时样本与总体均数的比较、配对设计资料的比较与两个小样本均数的比较。两样本均数比较时还要求所对应的总体方差齐同，资料服从正态分布。掌握“定量资料的统计描述和推断”知识点。